将38700修约为四位有效数字
A. 3.87
B. 3.871
C. 3870
D. 3.870*10⁴
E. 3.870*10⁵

正确答案：D。3.870*10⁴